药品费用急剧上涨的合理因素是
A. 零售药店少
B. 人口增加和老龄化
C. 以药养医
D. 财务管理人员不足
E. 新药科研资金少

正确答案：B。人口增加和老龄化